免疫球蛋白C区的功能
A. 穿越胎盘
B. 穿越黏膜
C. 激活补体
D. 结合Fc受体
E. 以上说法均正确

正确答案：E。以上说法均正确

解析：免疫球蛋白C区的功能：①激活补体；②结合Fc受体；③穿越胎盘；④穿越黏膜。掌握“免疫球蛋白的类型及功能”知识点。